男，38岁。发热伴腹胀、乏力1周。查体：T39℃，P84次/分，表情淡漠，胸部少许充血性皮疹，脾肋下可触及，质软。实验室检查：血WBC3.6×10⁹/L，N0.59，杆状核粒细胞0.01，L0.40。确诊最有价值的检查是
A. 外斐试验
B. PPD试验
C. 血培养
D. 布氏杆菌凝集试验
E. 血涂片找疟原虫

正确答案：C。血培养

解析：患者持续发热，消化系统异常（腹胀），神经系统出现中毒症状（表情淡漠），出现玫瑰疹（在发病一周后胸部出现充血皮疹），肝脾大等临床表现以及血常规结果与伤寒症状体征及实验室检查结果相符，所以最可能的诊断为伤寒，在使用抗生素前，血培养（C对）出伤寒沙门菌即可确诊。外斐试验（A错）常用于伤寒辅助诊断，PPD试验（B错）常用于结核病诊断，布氏杆菌凝集试验（D错）常用于布鲁菌病诊断，血涂片找疟原虫（E错）用于疟疾诊断。